当正中（牙合）和非正中（牙合）均有早接触时，应磨改
A. 上颌磨牙颊尖的斜面
B. 舌窝或窝的早接触区
C. 早接触的牙尖
D. 早接触的下前牙切缘
E. C+D

正确答案：E。C+D

解析：本题考查早接触点的选磨原则。（牙合）治疗是指通过多种手段达到建立起平衡的功能性咬合关系，有利于牙周组织的修复和健康。选磨法是（牙合）治疗的一种方法，通过选磨正中（牙合）、侧方（牙合）、前伸（牙合）的早接触点，以消除（牙合）创伤。当正中（牙合）和非正中（牙合）都存在早接触或不协调时，说明功能性牙尖或切缘与对颌牙的窝和斜面均有早接触，此时应磨改早接触的牙尖（C对）或下颌前牙的切缘（D对）。综上，CD均对（E对，为本题正确答案）。若正中（牙合）协调，非正中（牙合）不协调，在磨牙，应磨改上颌磨牙颊尖的（牙合）斜面（A错）和下颌磨牙舌尖的（牙合）斜面。若正中（牙合）有早接触，非正中（牙合）时协调，只能磨改其相对应的舌窝或（牙合）窝的早接触区（B错）。